成人低密度脂蛋白胆固醇的正常范围是
A. 0.56～1.70mmol/L
B. 1.2～1.65mmol/L
C. 2.1～3.1mmol/L
D. 3.1～5.7mmol/L
E. 3.3～5.5mmol/L

正确答案：C。2.1～3.1mmol/L

解析：本题考查低密度脂蛋白胆固醇的正常范围。成人低密度脂蛋白胆固醇的正常范围是2.1～3.1mmol/L（C对）。0.56～1.70mmol/L（A错）为甘油三酯的正常范围。